以医院为基础的病例对照研究的主要缺点是
A. 诊断标准不统一
B. 对象不易募集
C. 对象不易配合
D. 实验困难
E. 易造成选择偏倚

正确答案：E。易造成选择偏倚